下列精神药品所对应的习用名是：氯氮卓
A. 利眠宁
B. 速可眠
C. 利他林
D. 强痛定
E. 狄奥宁

正确答案：A。利眠宁